慢性应激时血液系统的表现是
A. 非特异性抗感染能力增强
B. 血液粘度增高
C. 红细胞沉降率增快
D. 可有类似于缺铁性贫血的表现
E. 以上都对

正确答案：D。可有类似于缺铁性贫血的表现

解析：可有类似于缺铁性贫血的表现（D对）是慢性应激时血液系统的表现。